男孩，6岁。因发热2周，头痛伴呕吐3天，惊厥1次入院。疑诊结核性脑膜炎。确诊后，强化治疗阶段的最佳方案是
A. INH RFP SM EMB
B. INH RFP PZA
C. INH RFP PZA SM
D. INH RFP EMB
E. INH RFP SM

正确答案：C。INH RFP PZA SM

解析：针对结核性脑膜炎的治疗原则是：早期、足量、联合、长期。在强化阶段需四联用药，且必须有INH 和RFP，最常用的配伍是INH RFP PZA SM（C对）。